结构中含5位氨基的，抗菌活性强，但有强光毒性的药物是
A. 盐酸诺氟沙星
B. 磺胺嘧啶
C. 氧氟沙星
D. 司帕沙星
E. 甲氧苄啶

正确答案：D。司帕沙星

解析：本题考查司帕沙星的结构特征。司帕沙星（D对）的结构含5位氨基，8位有氟原子取代，因而光毒性较强。盐酸诺氟沙星（A错）、磺胺嘧啶（B错）、氧氟沙星（C错）的5位碳原子均无氨基取代基。甲氧苄啶（E错）无较强光毒性。